在牙体纵剖面观察到的组织中，呈半透明白色、高度钙化的组织是
A. 牙髓
B. 牙本质
C. 牙骨质
D. 牙釉质
E. 以上都不是

正确答案：D。牙釉质

解析：在牙体纵剖面观察到的组织中，呈半透明的白色、高度钙化的组织是牙釉质。掌握“牙釉质”知识点。